下列哪项不属于突发公共卫生事件的特征
A. 突发公共卫生事件多为突然发生，发病很急
B. 突发公共卫生事件往往表现为病情严重、发病人数多或病死率高
C. 突发公共卫生事件影响到相当的群体，而非个别人或少数人
D. 突发公共卫生事件的发生和应急处理往往涉及社会的诸多方面
E. 突发公共卫生事件的发生一般都没有原因，所以从根本上说是不能预防和控制的

正确答案：E。突发公共卫生事件的发生一般都没有原因，所以从根本上说是不能预防和控制的